脏腑娇嫩，形体未充表明小儿是
A. 纯阳之体
B. 脏腑娇嫩
C. 稚阳之体
D. 稚阴之体
E. 稚阴稚阳之体

正确答案：E。稚阴稚阳之体

解析：古代儿科医家将小儿脏腑娇嫩，形气未充的特点，概括为“稚阴稚阳”（E对）。古代医家把小儿生机蓬勃、发育迅速的特点概括为“纯阳之体”或“体禀纯阳”（A错）。所谓脏腑娇嫩（B错），形气未充是指小儿时期机体各系统和器官的形态发育及生理功能均未发育完善，处在不成熟或不完善的过程中，且年龄越小，这种特点越突出。“稚阳”指的是各脏腑功能活动均属幼稚不足和处于不稳定状态（C错）。“稚阴”指的是精、血、津液，也包括脏腑、筋骨、脑髓、血脉、肌肤等有形之质，皆未充实、完善（D错）。